女性，10岁，诊断为重症心肌炎，心脏听诊可能出现的特征性体征是
A. 开瓣音
B. S₂固定分裂
C. 钟摆律
D. S₁增强
E. P₂增强

正确答案：C。钟摆律

解析：重症心肌炎时，第一心音失去原有性质且明显减弱，第二心音也弱，S₁（第一心音）、S₂（第二心音）极相似，可形成“单音律”。当心率增快，收缩期与舒张期时限几乎相等时，可听诊到钟摆律（C对）。开瓣音（九版诊断学P153）（A错）又称二尖瓣开放拍击声，常位于第二心音后0.05～0.06s，见于二尖瓣狭窄而瓣膜尚柔软时。S₂固定分裂（九版诊断学P151）（B错）指S₂分裂不受吸气、呼气的影响，S₂分裂的两个成分时距较固定，多见于房间隔缺损。S1增强（九版诊断学P151）（D错）常见于二尖瓣狭窄。P₂亢进（九版诊断学P151）（E错）常见于肺动脉高压。